不属于脓肿切开引流的指征的一项是
A. 触诊呈凹陷性水肿
B. 深部脓肿经穿刺有脓液
C. 急性化脓性炎症，经抗生素控制感染无效
D. 慢性根尖周炎瘘管形成
E. 局部疼痛加重，并呈搏动性跳痛

正确答案：D。慢性根尖周炎瘘管形成

解析：切开引流的指征：①局部疼痛加重，并呈搏动性跳痛，炎性肿胀明显，皮肤表面紧张、发红、光亮；触诊时有明显压痛点、波动感，呈凹陷性水肿；深部脓肿经穿刺有脓液抽出者。②口腔颌面部急性化脓性炎症，经抗生素控制感染无效，同时出现明显的全身中毒症状者。③儿童颌周蜂窝组织炎（包括腐败坏死性），如炎症已累及多间隙感染，出现呼吸困难及吞咽困难者，可以早期切开减压，能迅速缓解呼吸困难及防止炎症继续扩散。④结核性淋巴结炎，经局部及全身抗结核治疗无效，皮肤发红已近自溃的寒性脓肿，必要时也可行切开引流术。掌握“口腔颌面部感染概论”知识点。